仅用等渗盐水纠正等渗性缺水时，可导致
A. 高钠血症
B. 高氯血症
C. 水过多
D. 代谢性碱中毒
E. 低钙

正确答案：B。高氯血症

解析：等渗盐水的Na⁺和Cl⁻浓度均为154mmol/L，而血清Na⁺和Cl⁻含量分别为154和103mmol/L。若仅用等渗盐水纠正等渗性缺水，由于溶液中的Cl⁻含量比血清Cl⁻含量高50mmol/L，大量输入后会导致血Cl⁻过高，引起高氯血症（B对）。而平衡盐溶液的电解质含量和血浆内含量相仿，用来治疗等渗性缺水比较理想。血中Cl⁻过高，肾小管中的Cl⁻也相应升高，机体为维持离子平衡，代偿性的减少HCO₃⁻的重吸收，体内HCO₃⁻减少引发代谢性酸中毒（D错）。由于等渗盐水中Na⁺浓度与血清Na⁺浓度相等，故等渗性缺水时输入等渗盐水不会引起高钠血症（A错）。水过多（C错）即水中毒，指机体的摄水量超过了排水量而引起水分在体内潴留，多由抗利尿激素分泌过多、肾功能不全、静脉补液过量等原因引起。输注等渗性盐水时，只要不超量，一般不会导致水过多。低钙血症（E错）常见于急性重症胰腺炎、肾衰竭、甲状旁腺受损等，与输入等渗盐水无关。